首诊医师的医学伦理原则冲突
A. 尊重原则与公正原则
B. 保护原则与有利原则
C. 公正原则与有利原则
D. 尊重原则与自保原则
E. 有利原则与尊重原则

正确答案：E。有利原则与尊重原则

解析：患者自认为病情较轻，拒绝手术，再次入院后抢救无效死亡，说明首诊医师的医学伦理原则冲突有利原则与尊重原则（E对ABCD错）。